好发于青少年的牙髓炎是
A. 慢性增生性牙髓炎
B. 慢性闭锁性牙髓炎
C. 慢性溃疡性牙髓炎
D. 逆行性牙髓炎
E. 牙髓钙化

正确答案：A。慢性增生性牙髓炎

解析：本题考查好发于青少年的牙髓炎。慢性增生性牙髓炎的发生有两个条件，即患牙根尖孔粗大，血运丰富以及穿髓孔较大，足以允许炎症牙髓增生呈息肉状并且自髓腔突出，青少年的牙符合上述条件。因此，慢性增生性牙髓炎（A对）多见于青少年患者。慢性闭锁性牙髓炎（B错）、慢性溃疡性牙髓炎（C错）任何年龄段都可发生。逆行性牙髓炎（D错）常发生于伴有深牙周袋或严重根分叉病变的患者。牙髓钙化（E错）的发生无明显的年龄限制，多有外伤或氢氧化钙治疗史。